患者，女，36岁，近期经常上腹灼烧痛、反酸疼痛，多出现在上午10点及下午4点，有时夜间痛醒进食后缓解，X线钡餐诊断为十二指肠溃疡，该患者宜使用的治疗药物是
A. 颠茄
B. 多潘立酮
C. 奥美拉唑
D. 甲氧氯普胺
E. 莫沙必利

正确答案：C。奥美拉唑

解析：本题考查奥美拉唑。该患者诊断为十二指肠溃疡，宜使用的治疗药物是奥美拉唑（C对）；颠茄（A错）具有抗胆碱，解除平滑肌痉挛，抑制腺体分泌的功效，用于胃及十二指肠溃疡，胃肠道，肾，胆绞痛等；多潘立酮（B错）为胃肠动力药，用于消化不良、腹胀、嗳气、恶心、呕吐、腹部胀痛；甲氧氯普胺（D错）为镇吐药，用于化疗、放疗、手术、颅脑损伤、脑外伤后遗症、海空作业以及药物引起的呕吐等；莫沙必利（E错）为消化道促动力剂，主要用于功能性消化不良伴有胃灼热、嗳气、恶心、呕吐、早饱、上腹胀、上腹痛等。